女，31岁。婚后2年未孕，性生活正常，既往痛经5年，妇科检查：子宫后倾后屈位，正常大小，活动度差，后穹隆有触痛结节，子宫左侧可触及直径5cm包块，该患者最可能的诊断是
A. 输卵管妊娠
B. 生殖器结核
C. 盆腔炎性疾病
D. 卵巢上皮性癌
E. 子宫内膜异位症

正确答案：E。子宫内膜异位症

解析：中年女性患者，婚后2年未孕，性生活正常，既往痛经5年，妇科检查：子宫后倾后屈位，正常大小，活动度差，后穹隆有触痛结节，子宫左侧可触及直径5cm包块，患者有痛经及不孕史，综合患者的症状、体征和辅助检查，该患者最可能的诊断是子宫内膜异位症（E对）。输卵管妊娠（A错）主要表现为停经、腹痛、阴道不规则流血。生殖器结核（B错）多有结核病史及结核中毒症状。盆腔炎性疾病（C错）主要表现为子宫颈举痛或子宫压痛或附件区压痛。卵巢上皮性癌（D错）早期癌多无明显症状，较晚期的病人可有消瘦、低热、食欲缺乏及胃肠功能紊乱等症状，盆腔检查可触及囊实性肿块。